对青霉素G基本无效的是
A. 白喉棒状杆菌
B. 脑膜炎奈瑟菌
C. 金黄色葡萄球菌
D. 淋病奈瑟菌
E. 梅毒螺旋体

正确答案：C。金黄色葡萄球菌

解析：金黄色葡萄球菌、淋病奈瑟菌、肺炎球菌、脑膜炎奈瑟菌对青霉素G极易产生耐受性，因此青霉素G对抗药金黄色葡萄球菌无效（C错，为本题正确答案）。青霉素G的抗菌作用很强，对病原菌有高度抗菌活性：①大多数G⁺球菌如溶血性链球菌、肺炎球菌、草绿色链球菌、敏感金黄色葡萄球菌和表皮葡萄球菌等；②G⁺杆菌如白喉棒状杆菌（A对）、炭疽杆菌、产气荚膜梭菌、破伤风杆菌、乳酸杆菌等；③G⁻球菌如脑膜炎奈瑟菌（B对）、敏感淋病奈瑟菌等（D对）；④少数G⁻杆菌如流感杆菌、百日咳鲍特菌等；⑤螺旋体、放线杆菌，如梅毒螺旋体（E对）、钩端螺旋体、回归热螺旋体、牛放线杆菌等。对大多数G⁻杆菌作用较弱，对肠球菌不敏感，对真菌、原虫、立克次体、病毒等无作用。